通过对脱落细胞进行检查，对宫颈癌的筛检属于
A. 整群筛检
B. 多项筛检
C. 选择性筛检
D. 预防性筛检
E. 治疗性筛检

正确答案：E。治疗性筛检